关于空胶囊和硬胶囊剂的说法错误的是
A. 吸湿性很强的药物不宜制成硬胶囊剂
B. 明胶是空胶囊的主要材料
C. 空胶囊的规格号数越大，容量越大
D. 硬胶囊剂可以掩盖药物的不良臭味
E. 硬胶囊剂可以提高药物的稳定性

正确答案：C。空胶囊的规格号数越大，容量越大

解析：本题考查空胶囊的规格。空胶囊共有8种规格，即000、00、0、1、2、3、4和5号，常用的为0～5号，随着号数由小到大，容积由大到小（C错。为本题正确答案）。胶囊壳的主要材料是明胶、植物纤维素及其衍生物，不能填充水溶液或稀乙醇溶液，以防囊壁溶化；另外，易风化而失去结晶水的药物、易潮解而吸水的药物均不宜制成胶囊剂（A对）。胶囊壳在体内溶化后，局部药物浓度很高，因此易溶性的刺激性药物也不宜制成胶囊剂。明胶是空胶囊的主要材料（B对）。胶囊剂的特点包括：①掩盖药物的不良臭味（D对），增加患者的顺应性；②提高药物稳定性（E对），且药物在体内起效快；③实现液态药物的固体化；④可延缓、控制或定位释放药物。